与白血病有关的病毒是
A. EBV
B. HTLV
C. HBV
D. VZV
E. HPV

正确答案：B。HTLV

解析：与白血病有关的病毒是HTLV（B对），HTLV（人类嗜T细胞病毒）分为HTLV-1和HTLV-2两型，HTLV-1是成人T淋巴细胞白血病的病原体，HTLV-2引起毛细胞白血病。EBV（A错）原发性感染者约有半数可表现为传染性单核细胞增多症，与非洲儿童恶性淋巴瘤和鼻咽癌的发病密切相关（P300）。HBV（C错）即乙型肝病毒，引起人类乙型肝炎，可表现为重症肝炎、急性肝炎、慢性肝炎或无症状者带者（P265）。VZV（D错）即水痘-带状疱疹病毒，是引起水痘和带状疱疹的病原体（P297）。HPV（E错）即人类乳头瘤病毒，主要引起人类皮肤黏膜的增生性病变，其中高危性HPV（16型、18型等）与子宫颈癌等恶性肿瘤的发生密切相关，低危性HPV（6型、11型等）引起生殖器尖锐湿疣（P316）。